侧舌隆突未联合形成
A. 地图舌
B. 叉舌
C. 沟纹舌
D. 菱形舌
E. 光滑舌

正确答案：B。叉舌

解析：侧舌隆突未联合，则形成分叉舌。掌握“腭部与舌的发育”知识点。